心室颤动时初诊，首次电除颤的能量
A. 360J
B. 300J
C. 200J
D. 150J
E. 100J

正确答案：C。200J

解析：根据第九版外科学教材的说明，心室颤动时首次电除颤，AHA复苏指南推荐直接使用最大能量除颤，双相波200J（或制造商建议的能量，150~200J），单相波360J”（C对）。但题目与答案并未说明是单相波还是双相波，故本题不严谨，答案有争议。